可引起Q-T间期轻度延长的药物是
A. 兰索拉唑
B. 多潘立酮
C. 枸橼酸铋钾
D. 法莫替丁
E. 硫糖铝

正确答案：B。多潘立酮

解析：本题考查多潘立酮。可引起Q-T间期轻度延长的药物是多潘立酮（B对）。多潘立酮在胃肠道出血、机械性肠梗阻、胃肠穿孔、分泌催乳素的垂体肿瘤患者禁用。只有当FD患者出现恶心和呕吐时，才建议使用多潘立酮进行治疗。另外，因其可引起Q-T间期延长，导致心律失常，因此不宜与酮康唑口服制剂、红霉素或其他可能延长Q-T间期的CYP3A4酶强抑制剂（如氟康唑、伏立康唑、克拉霉素、胺碘酮、泰利霉素等）联用。质子泵抑制剂如奥美拉唑、雷贝拉唑、埃索美拉唑、泮托拉唑、兰索拉唑（A错），长期服用影响钙吸收，可致骨质疏松；维生素B₁₂和维生素C吸收下降，增加感染风险，便秘、口干。枸橼酸铋钾（C错）所致的主要不良反应是黑便，大量长期服用可有脑、肾毒性。法莫替丁（D错）属于组胺H₂受体阻断剂，能够有效的抑制胃酸及胃蛋白酶的分泌。不良反应可使驾驶员出现定向力障碍。硫糖铝（E错）主要的不良反应为便秘，偶见口干、恶心、腹泻等，长期服用可导致低磷血症。